尺神经叙述错误的是
A. 发自臂丛内侧束
B. 经尺神经沟下行
C. 分布于前臂前群肌
D. 损伤后屈腕减弱
E. 损伤后拇指不能内收

正确答案：C。分布于前臂前群肌

解析：尺神经自臂丛内侧束（A对）发出后，从腋动、静脉之间穿出腋窝，在肱二头肌内侧沟伴行于肱动脉内侧至臂中部。继而穿内侧肌间隔至臂后区内侧，下行进入肱骨内上髁后方的尺神经沟（B对）。尺神经分为浅支和深支，支分布于小鱼际表面的皮肤、小指掌面皮肤和环指尺侧半掌面皮肤。深支分布于小鱼际肌、拇收肌、骨间掌侧肌、骨间背侧肌及第3、4蚓状肌（C错，为本题正确选项）。尺神经孙受导致屈腕减弱（D对），拇指不能内收（E对），出现“爪形手”。